结合上皮
A. 是牙龈上皮附着在牙表面的一条带状上皮
B. 是牙龈上皮在游离龈的边缘转向内侧覆盖的龈沟壁形成的上皮
C. 是有角化的复层鳞状上皮，有上皮钉突
D. 连接牙槽骨和牙骨质之间的致密结缔组织
E. 属于成熟分化的上皮组织

正确答案：A。是牙龈上皮附着在牙表面的一条带状上皮

解析：结合上皮是牙龈上皮附着在牙表面的一条带状上皮，从龈沟底开始，向根尖方向附着在釉质或者牙骨质的表面。属于无角化的鳞状上皮，无上皮钉突。结合上皮是一种未成熟的分化低的简单上皮。掌握“牙龈”知识点。